《素问·气穴论》称具有“溢奇邪”“通营卫”作用的是
A. 皮部
B. 孙络
C. 浮络
D. 别络
E. 大络

正确答案：B。孙络

解析：络脉，是经脉的分支，有别络、浮络、孙络之分。其中，孙络是最细小的络脉，属络脉的再分支，分布全身，难以计数，有“溢奇邪”、“通营卫”的作用（B对）。皮部是十二经脉及其所属络脉在体表的分区，经气布散之所在，具有保卫机体，抗御外邪的机能，并能反映十二经脉的病证（A错）。浮络，是循行于人体浅表部位且常浮现的络脉，起着沟通经脉，输达肌表的作用（C错）。别络是络脉中较大者，可加强十二经脉相表里两经之间在体表的联系，还可补正经之不足，并能统领一身阴阳诸络（D错）。络脉的干线部分分为二大类：一是从体表络穴分出的“别络”为十四络，二是从体内经脉别出的“大络”，如脾胃之大络，它们是经脉气血营养体内外组织器官的重要通道（E错）。